治疗呼吸道感染宜选
A. 磺胺嘧啶（SD）+TMP
B. 磺胺甲噁唑（SMZ）+TMP
C. 酞磺胺噻唑（PST）
D. 磺胺醋酰钠（SA）
E. 磺胺嘧啶（SD）+链霉素

正确答案：B。磺胺甲噁唑（SMZ）+TMP

解析：本题考查药物的联合应用。磺胺甲噁唑（B对）（SMZ）+TMP为复方新诺明，用于治疗呼吸道感染、尿路感染等。治疗流行性脑脊髓膜炎宜选磺胺嘧啶（SD）+TMP（A错）。甲氧苄啶（TMP）为磺胺类药物的抗菌增效剂，磺胺嘧啶（SD）为流行性脑脊髓膜炎的首选药物之一，两者合用用于治疗流行性脑脊髓膜炎。酞磺胺噻唑（PST）（C错）临床用于肠炎、菌痢及肠道术前准备；磺胺醋酰钠（SA）（D错）属于外用磺胺类，临床主要用于沙眼及眼部其它感染的治疗。治疗鼠疫宜选磺胺嘧啶（SD）+链霉素（E错）。链霉素目前仅用于某些不常见感染，与其它抗菌药物联合用于鼠疫和兔热病。